寒凉性表示药物具有的作用包括
A. 清热
B. 泻火
C. 凉血
D. 散风
E. 解热毒

正确答案：A、B、C、E。清热；泻火；凉血；解热毒

解析：本题考查四气所示效用。寒凉性表示药物具有的作用包括清热（A对）、泻火（B对）、凉血（C对）、解热毒（E对）。四气，从本质而言只有寒热二性。凡寒凉性药物，即表示其具有清热、泻火、凉血、解热毒等作用；凡温热性药物，即表示其具有温里散寒、补火助阳、温经通络、回阳救逆等作用。四气对人体的作用也有两面性，倘若应用不当，即可对人体产生不良作用。此时，寒凉性有伤阳助寒之弊，而温热性则有伤阴助火之害。